4～6个月婴儿不宜添加的食物是
A. 菜泥
B. 水果泥
C. 配方奶
D. 肉末
E. 米粉

正确答案：D。肉末

解析：肉末含有大量的优质蛋白和脂肪，4～6个月婴儿消化能力尚不能完全消化和吸收肉类，易造成小儿消化不良和腹泻，故不宜添加肉末（D错，为本题正确答案）。菜泥（A对）、水果泥（B对）、配方奶（C对）、米粉（E对）均可作为辅食添加给6月龄的婴儿。